体内代谢时，由硫醚转化为亚砜，活性提高的是
A. 苯妥英
B. 氯霉素
C. 舒林酸
D. 利多卡因
E. 阿苯达唑

正确答案：E。阿苯达唑

解析：本题考查药物化学结构与第Ⅰ相生物转化的规律。阿苯达唑（E对）结构中含硫醚，体内代谢时，由硫醚代谢成成亚砜后，抗寄生虫活性增强。苯妥英（A错）、氯霉素（B错）、利多卡因（D错）均不含有硫醚的结构。舒林酸（C错）含甲基亚砜基结构，体内代谢时会被还原成甲硫基化合物，进而显示生物活性。